高温消毒的方法包括
A. 巴氏消毒法
B. 超高温瞬时灭菌法
C. 煮沸消毒
D. 微波消毒
E. 以上都是

正确答案：E。以上都是